某中年男性因突发急症在大街上摔倒并昏迷，由路人送至附近医院，被确诊为脑出血，急需手术，但医务人员无法联系到其亲属。在此情况下，可以决定为其急诊手术的人员是
A. 医院所在地民政部门负责人
B. 医院所在地派出所负责人
C. 为其接诊医师的上级医师
D. 院长或其授权人
E. 为其接诊的医师

正确答案：D。院长或其授权人

解析：患者突发急症需行急诊手术，无法联系到其亲属的情况下，按我国《医疗机构管理条例》第33条规定，应取得医疗机构负责人或者被授权负责人员即院长或其授权人（D对）的批准后实施。